地黄炮制成熟地黄的作用是
A. 清热凉血
B. 生津止渴
C. 滋阴清热凉血
D. 滋阴补血
E. 补血止血

正确答案：D。滋阴补血

解析：本题考查的是地黄的炮制作用。地黄炮制成熟地黄的作用是滋阴补血（D对）。地黄：【炮制作用】鲜地黄味甘、苦，性寒。归心、肝、肾经。具有清热生津、凉血（A错）、止血的功能。用于热病伤阴，舌绛烦渴，温毒发斑，吐血衄血，咽喉肿痛等症。①生地黄性味甘，寒。归心、肝、肾经。为清热凉血之品，具有清热凉血、养阴生津的功能。用于热入营血，温毒发斑，吐血衄血，热病伤阴，舌绛烦渴，津伤便秘，阴虚发热，骨蒸劳热，内热消渴。②熟地黄药性由寒转温，味由苦转甜，功能由清转补，熟地黄质厚味醇，滋腻碍脾，酒制主补阴血，且可借酒力行散，起到行药势、通血脉的作用。熟地黄性味甘，微温。归肝、肾经。具有补血滋阴（C错），益精填髓的功能。用于血虚萎黄，心悸怔忡，月经不调，崩漏下血，肝肾阴虚，腰膝酸软，骨蒸潮热，盗汗遗精，内热消渴，眩晕，耳鸣，须发早白。③生地炭入血分凉血止血，用于吐血，衄血，尿血，便血，崩漏等。④熟地炭以补血止血（E错）为主，用于虚损性出血。生津止渴（B错）为葛根的功效。葛根既能生津止渴，又能发表透疹。